“水寒射肺”属于
A. 子病及母
B. 母病及子
C. 相乘传变
D. 制化传变

正确答案：A。子病及母

解析：肺在五行之中属金，与水的关系为金生水，金为母，水为子，"水寒射肺"为子病及母（A对）。制化传变指五行之间逆相生化，又逆相制约，生化中有制约，制约中有生化，二者相辅相成，从而维持其相对平衡和正常的协调关系（D错）。母病及子是指五行中的某一行异常，累及其子行，导致母子两行皆异常（B错）。相乘传变指五行中所不胜一行对其所胜一行的过度制约或克制，金水无相克关系（C错）。